绝经前后诸证肾阳虚的表现不包括以下
A. 面色晦暗,精神萎靡
B. 形寒肢冷，面浮肢肿
C. 小便频数，大便溏薄
D. 舌淡苔薄，脉沉细无力
E. 月经周期紊乱，量少色红

正确答案：E。月经周期紊乱，量少色红

解析：绝经前后诸证肾阳虚证候分析：肾虚封藏失职，冲任不固，不能制约经血，则月经量多，经色黯淡（E错），肾阳虚疲，命门火衰，阳气不能外达，经脉失于温煦，故面色晦暗，精神萎靡（A对）肾阳虚，失于温煦，膀胱气化无力，则小便清长，夜尿频多（C对）水湿内停，泛溢肌肤则面浮肢肿（B对）舌淡，或胖嫩边有齿痕，苔薄白，脉细弱皆为肾阳虚衰之象（D对）。